哮喘持续状态有效的药物治疗是
A. 头孢他啶
B. 阿托品
C. 地塞米松
D. 杜冷丁
E. 右旋糖苷40

正确答案：C。地塞米松

解析：地塞米松（C对）及其类似的糖皮质激素通过吸入直接作用于气道黏膜，局部抗炎作用强，全身不良反应少，是针对喘持续状态有效的药物治疗。严重时也可全身性糖皮质激素应用。哮喘没有合并细菌感染时不必要使用头孢他啶（A错）等抗生素。阿托品（B错）是M样胆碱受体拮抗剂，可减少呼吸道腺体的分泌，减轻气道痉挛，在一定程度上也能缓解哮喘持续状态，但它同时对其他系统譬如心血管、神经系统有较大的副作用，故不用于哮喘持续状态的治疗。度冷丁（D错）是阿片类镇痛剂，右旋糖酐40（E错）主要用与补充血容量，两者不是哮喘持续状态的治疗药物。